药物的副反应是
A. 难以避免的
B. 较严重的药物不良反应
C. 剂量过大时产生的不良反应
D. 药物作用选择性高所致
E. 与药物治疗目的有关的效应

正确答案：A。难以避免的

解析：药物的副作用是指由于药物的选择性低（D错），药理效应涉及多个器官，当某一效应用作治疗目的时，其他效应就成为副作用（E错），可见药物的副作用是难以避免的（A对）。毒性反应是指在剂量过大（C错）或药物在体内蓄积过多时发生的危害性反应，一般是比较严重的中毒反应（B错）（P22）。